某人在意外事故中脊髓受损，丧失横断面以下一切躯体与内脏反射活动，但数周后屈肌反射，腱反射等反射开始逐渐恢复。这表明该患者在受伤当时出现了
A. 脑震荡
B. 脑水肿
C. 脊休克
D. 脊髓水肿
E. 疼痛性休克

正确答案：C。脊休克